女，42岁，人工流产术后2年，阴道断续流血6月余，近日出现咳血丝痰。血β-hCG为1300U/L，胸部X线片示肺部多个结节。首选的治疗方法是
A. 肺叶切除+子宫切除术
B. 放射治疗
C. 肺叶切除术
D. 化学治疗
E. 子宫切除术

正确答案：D。化学治疗

解析：患者为中年女性，人工流产术后2年（非葡萄胎妊娠），阴道断续流血6月（妊娠滋养细胞肿瘤在葡萄胎排空、流产或足月产后，有持续的不规则阴道流血，量多少不定），近日出现咳血丝痰（肺转移典型表现胸痛、咳嗽、咯血及呼吸困难）。血β-hCG为1300U/L（足月产、流产和异位妊娠后hCG多在4周左右转为阴性，若超过4周血清hCG仍持续高水平，或一度下降后又上升，在除外妊娠物残留或再次妊娠后，可诊断妊娠滋养细胞肿瘤），胸部X线片示肺部多个结节阴影（肺转移的最初X线征象为肺纹理增粗，以后发展为片状或小结节阴影），考虑为妊娠滋养细胞肿瘤。因非葡萄胎妊娠只继发绒癌，故诊断为绒癌，其治疗原则是以化疗为主、手术和放疗为辅的综合治疗，故首选的治疗方法是化学治疗（D对）；手术治疗为辅助治疗，包括子宫切除和肺叶切除术，前者用于无生育要求的无转移患者或大病灶、耐药病灶、病灶穿孔出血者，后者用于多次化疗仍有未能吸收的孤立耐药病灶，且血hCG水平不高的患者，故肺叶切除+子宫切除术（A错）、肺叶切除术（P342）（C错）、子宫切除术（P342）（E错）不是首选的方法；放射治疗（P342）（B错）应用较少，主要用于肝、脑转移和肺部耐药病灶的治疗。